肺气肿病人的叩诊音应是
A. 清音
B. 过清音
C. 鼓音
D. 浊音
E. 实音

正确答案：B。过清音

解析：肺气肿时，肺部叩诊音应是过清音（B对）。过清音是介于鼓音和清音之间的音响，音调较清音低，音响较清音强。清音（A错）是正常肺部的叩诊音。鼓音（C错）是一种和谐的乐音，音响比清音更强，振动持续时间也较长，可见于大量气胸、肺空洞。浊音（D错）是一种音调较高，音响较弱，振动持续时间较短的非乐性叩诊音，可见于大叶性肺炎。实音（E错）是一种音调较浊音更高，音响更弱，振动持续时间更短的一种非乐性音，可见于大量胸腔积液以及肺实变。